服用六味地黄丸宜用药引
A. 黄酒
B. 姜片汤
C. 淡盐水
D. 芦根汤
E. 清茶

正确答案：C。淡盐水

解析：本题考查的是中成药与药引的配伍应用。服用六味地黄丸宜用药引淡盐水（C对）。滋阴补肾的六味地黄丸、大补阴丸等宜用淡盐水送服，以取其引药入肾之功。对于跌打损伤、风寒湿痹等证，常用黄酒（A错）或白酒送服三七粉、云南白药、三七伤药片、七厘散、大活络丸、再造丸、醒消丸、跌打丸、独活寄生丸、腰痛宁胶囊等，以行药势，直达病所，黄酒一般用15～20ml，白酒酌减。外感风寒或脾胃虚寒之呕吐泄泻等病证，常用生姜（B错）、大枣煎汤送服中成药，如治风寒表实咳嗽的通宣理肺丸、温中散寒的附子理中丸、和中解表的藿香正气水等，以增强散风寒、和脾胃、温中止呕之功，一般用生姜3～5片，水煎取汤送服。治疗风热感冒的银翘解毒丸用鲜芦根煎汤（D错）送服，取其清热透表生津的协同作用。川芎茶调散用清茶（E错）送服，取其清热之效。